男，26岁。感冒2周后出现双下肢近端无力。查体：双上肢肌力3级，双下肢肌力3级，四肢腱反射消失，手套袜子样痛觉减退，双侧腓肠肌压痛。其原因最可能是
A. 急性脊髓炎
B. 脊髓压迫症
C. 周期性麻痹
D. 急性肌炎
E. 急性炎症性脱髓鞘性多发性神经病

正确答案：E。急性炎症性脱髓鞘性多发性神经病

解析：急性炎症性脱髓鞘性多发性神经病（AIDP）是吉兰-巴雷综合征（GBS）中最常见的一种自身免疫介导的周围神经病，主要损害多数脊神经根和周围神经，也常累及脑神经。临床表现有等前驱感染史、多在2周左右达高峰，首发症状多为肢体对称性迟缓性肌无力，且多由近端向远端加重，四肢腱反射减弱或消失，感觉缺失较轻、呈手套-袜套样分布，少数患者可有双腓肠肌的压痛。本例患者为青年男性，感冒（前驱感染史）2周后出现双下肢近端无力，查体：四肢肌力均为3级，四肢腱反射消失，手套袜子样痛觉减退，双腓肠肌压痛阳性，与急性炎症性脱髓鞘性多发性神经病（E对）诊断相符。急性脊髓炎（A错）会有病损平面以下肢体瘫痪、传导束性感觉障碍和尿便障碍表现（P322）。脊髓压迫症（B错）会有病损平面以下同侧肢体上运动神经元瘫痪，深感觉消失、精细触觉障碍，血管舒缩功能障碍表现（P325）。周期性麻痹（C错）表现为反复发作的骨骼肌弛缓性瘫痪（P370）。急性肌炎（D错）首发症状通常为四肢近端无力，但还会有皮疹，恶心、呕吐、痉挛性腹痛等表现（P374）。